服用后可能导致口中有氨味、舌苔、大便呈灰黑色的药物是
A. 奥美拉唑
B. 硫糖铝
C. 枸橼酸铋钾
D. 西咪替丁
E. 帕托拉唑

正确答案：C。枸橼酸铋钾

解析：本题考查枸橼酸铋钾。铋剂包括铝酸铋、碱式碳酸铋、枸橼酸铋钾（C对）、胶体果胶铋等。能与溃疡基底膜坏死组织上的蛋白或氨基酸结合，形成蛋白质-铋复合物，覆盖于溃疡表面起到黏膜保护作用。服用铋剂期间，舌苔和大便可能呈无光泽的灰黑色，如患者无其它不适，即属于正常。停药后1～2日内粪便色泽可恢复正常。为了防止铋中毒，含铋剂的药品不宜联用。硫糖铝及铋剂连续用药不宜超过2月。铋剂停用2个月后可再进行下一个疗程。